属于眼球外膜的结构有
A. 角膜、虹膜
B. 角膜、巩膜
C. 角膜、结膜
D. 巩膜、脉络膜

正确答案：B。角膜、巩膜

解析：角膜和巩膜（B对）属于眼球纤维膜，即眼球外膜。虹膜（A错）和脉络膜（D错）属于眼球中膜。结膜（C错）属于眼副器，不属于眼球外膜。